沉香除行气止痛外，又能
A. 温肾纳气
B. 调经止痛
C. 散结消滞
D. 杀虫疗癣
E. 燥湿化痰

正确答案：A。温肾纳气

解析：本题考查的是沉香的功效。沉香除行气止痛外，又能温肾纳气（A对）。沉香：【功效】行气止痛，温中止呕，温肾纳气。香附：【功效】疏肝理气，调经止痛（B错）。青皮：【性能特点】本品苦降下行，辛温行散，药力颇强，入肝、胆、胃经。既善疏肝破气，治肝郁胁痛、乳房疾患、寒疝腹痛；又善散结消滞（C错），治癥瘕积聚、久疟癖块及食积腹痛。【功效】疏肝破气，消积化滞。川楝子：【功效】行气止痛，杀虫，疗癣（D错）。橘红：【功效】行气宽中，燥湿化痰（E错），发表散寒。